阿片类药物中毒的解救药物是
A. 阿托品+碘解磷定
B. 氟马西尼
C. 硫代硫酸钠
D. 乙酰半胱氨酸
E. 纳洛酮

正确答案：E。纳洛酮

解析：本题考查中毒解救。阿片类药物中毒的解救药物是纳洛酮（E对）。阿托品+碘解磷定（A错）可用于有机磷中毒解救。氟马西尼（B错）可用于地西泮中毒解救。硫代硫酸钠（C错）主要用于氰化物中毒，也用于砷、汞、铅中毒等。乙酰半胱氨酸（D错）用于对乙酰氨基酚过量所致的中毒。